涎石摘除术的适应证包括
A. 涎石在导管内，腺体有纤维化者
B. 涎石在腺体内，腺体未纤维化者
C. 涎石在导管内，腺体未纤维化者
D. 涎石在导管与腺体交接处
E. 涎石在腺体内，进食有明显肿胀者

正确答案：C。涎石在导管内，腺体未纤维化者

解析：本题考查涎石病及下颌下腺炎。切开取石术适用于能扪及相当于下颌第二磨牙以前部位的涎石，无下颌下腺反复感染史，腺体尚未纤维化（C对），99mTc功能测定腺体功能存在者。对于体积较大的下颌下腺导管结石，宜行导管再通术，使唾液从正常导管口排出。有利于术后下颌下腺功能的恢复。